某研究者预计用个体危险度隶属度函数（AD）值对大肠癌进行初筛，对初筛阳性者再行纤维肠镜筛检，该筛检试验方法是哪种联合试验，可达到的效果是
A. 并联试验，可提高特异度
B. 串联试验，可提高特异度
C. 串联试验，可提高灵敏度
D. 并联试验，可提高灵敏度
E. 并联试验，可提高阴性预测值

正确答案：B。串联试验，可提高特异度

解析：本题考查串联试验。串联试验也称系列试验，即一组筛检试验按一定的顺序相连，初筛阳性者进入下一轮筛检，全部筛检试验结果均为阳性者才定为阳性。该法可以提高特异度，但会使灵敏度降低。可知本题中该筛检试验方法是串联试验，可达到的效果是提高特异度（B对ACDE错）。